辛伐他汀主要用于治疗
A. 高甘油三酯血症
B. 高胆固醇血症
C. 高磷脂血症
D. 心绞痛
E. 心律不齐

正确答案：B。高胆固醇血症

解析：本题考查他汀类药物。辛伐他汀主要用于治疗高胆固醇血症（B对）。高甘油三酯血症（A错）是血液中甘油三酯水平过高，常用药物包括贝特类、烟酸类或他汀类。高磷脂血症（C错）是指血脂水平过高，引起一些严重危害人体健康的疾病，治疗以饮食控制为主，药物治疗为辅。心绞痛（D错）是冠状动脉供血不足，心肌缺血缺氧引起的临床综合症，常用药物为硝酸甘油。心律不齐（E错）指相邻的两次心跳用时不一，常用心律失常药。